男，30岁，间断右下腹痛一年。加重伴腹泻一月，大便每日4-5次，黄色稀便，无黏液脓血，伴低热，体重减轻4kg。既往反复发作肛瘘1年，曾手术治疗。查体：T37.5℃，右下腹轻压痛，肛门视诊可见肛瘘开口，粪隐血（+++），肠镜检查发现回肠末端、回盲瓣多发溃疡，病变间黏膜基本正常。结肠、直肠未见明显异常。可诊断为
A. 贝赫切特病
B. 溃疡性结肠炎
C. 克罗恩病
D. 淋巴瘤
E. 肠结核

正确答案：C。克罗恩病

解析：患者间断右下腹痛、腹泻（黄色稀便，无黏液脓血）、体重减轻，伴低热、肛瘘，肠镜检查发现回肠末端、回盲瓣多发溃疡，病变间黏膜基本正常（P375）。可诊断为克罗恩病（C对）。克罗恩病是一种慢性炎性肉芽肿性疾病，多见于末段回肠和邻近结肠，但从口腔至肛门各段消化道均可受累，呈节段性分布。以腹痛、腹泻、体重下降为主要临床表现，常有发热、疲乏等全身表现，肛周脓肿或瘘管等局部表现。贝赫切特病（A错）以口腔和外阴溃疡、眼炎为临床特征（P843）。溃疡性结肠炎（B错）的主要症状：反复发作的腹泻、黏液脓血便及腹痛。淋巴瘤（D错）临床表现为非特异性的胃肠道症状，如腹痛、腹部包块、体重下降、肠梗阻、消化道出血等较为多见，发热少见。肠结核（E错）肛周脓肿或瘘管少见，常无病变节段性分布（P369）。